国家基本药物目录在保持数量相对稳定的基础上，实行动态管理。在此过程中调整品种和数量的因素包括
A. 已上市药品循证医学、药物经济学评价
B. 药品不良反应监测评价
C. 我国疾病谱变化
D. 基本医疗卫生需求和基本医疗保障水平变化

正确答案：A、B、C、D。已上市药品循证医学、药物经济学评价；药品不良反应监测评价；我国疾病谱变化；基本医疗卫生需求和基本医疗保障水平变化

解析：本题考查的是国家基本药物目录的调整。国家基本药物目录在保持数量相对稳定的基础上，实行动态管理。在此过程中调整品种和数量的因素包括已上市药品循证医学、药物经济学评价（A对）、药品不良反应监测评价（B对）、我国疾病谱变化（C对）与基本医疗卫生需求和基本医疗保障水平变化（D对）。国家基本药物目录的调整：基本药物目录管理采取以下举措：一是坚持防治必需，以满足疾病防治基本用药需求为导向，基本药物品种数量能够满足常见病、慢性病、应急抢救等主要临床需求，以及儿童等特殊人群和公共卫生防治用药需求。二是强化循证决策，调入和调出并重，突出药品临床价值，以诊疗规范、临床诊疗指南和专家共识为依据，优先调入有效性和安全性证据明确、成本效益比显著的药品品种。重点调出已退市的，发生严重不良反应较多、经评估不宜再作为基本药物的，以及有风险效益比或成本效益比更优的品种替代的药品。三是动态调整目录，对基本药物目录定期评估，动态调整，调整周期原则上不超过3年。对新审批上市、疗效有显著改善且价格合理的药品，可适时启动调入程序。除少数民族地区可增补少量民族药外，原则上各地不增补药品。四是加强上下级医疗机构的用药衔接，适应分级诊疗制度建设需求，推进市（县）域内公立医疗机构集中带量采购，规范基本药物采购的品种、剂型、规格，满足群众需求。国家基本药物目录的品种和数量调整应当根据以下因素确定：①我国基本医疗卫生需求和基本医疗保障水平变化；②我国疾病谱变化；③药品不良反应监测评价；④国家基本药物应用情况监测和评估；⑤已上市药品循证医学、药物经济学评价；⑥国家基本药物工作委员会规定的其他情况。属于下列情形之一的品种，应当从国家基本药物目录中调出：①药品标准被取消的；②国家药品监督管理部门撤销其药品批准证明文件的；③发生严重不良反应，经评估不宜作为国家基本药物使用的；④根据药物经济学评价，可被风险效益比或成本效益比更优的品种所替代的；⑤国家基本药物工作委员会认为应当调出的其他情形。